制洞的常用牙钻是
A. 球钻
B. 裂钻
C. 倒锥钻
D. 球钻、裂钻、倒锥钻

正确答案：D。球钻、裂钻、倒锥钻

解析：本题考查制洞的常用牙钻。制洞的常用牙钻是球钻、裂钻、倒锥钻（D对）。